依照《处方药与非处方药流通管理暂行规定》，取得准销标志的普通商业零售企业可以销售的药品是
A. 乙类非处方药
B. 甲类非处方药
C. 处方药、非处方药
D. 非处方药
E. 处方药

正确答案：A。乙类非处方药

解析：本题考查普通商业企业零售规定。依照《处方药与非处方药流通管理暂行规定》，取得准销标志的普通商业零售企业可以销售的药品是乙类非处方药（A对）。《处方药与非处方药流通管理暂行规定》第五章普通商业企业零售第十九条：在药品零售网点数量不足、布局不合理的地区，普通商业企业可以销售乙类非处方药，但必须经过当地地市级以上药品监督管理部门审查、批准、登记，符合条件的颁发乙类非处方药准销标志。具体实施办法由省级药品监督管理部门制定。根据便民利民的原则，销售乙类非处方药的普通商业企业也应合理布局。鼓励并优先批准具有《药品经营企业许可证》的零售药店与普通商业企业合作在普通商业企业销售乙类非处方药。